女，67岁，发作性胸骨闷痛4个月，近1周劳动耐量减小，发作频率高及疼痛时间增加来诊。该患者最可能的诊断是
A. 心脏神经症
B. 恶化型劳力性心绞痛
C. 心肌梗死
D. 稳定型心绞痛
E. 肥厚型心肌病

正确答案：B。恶化型劳力性心绞痛

解析：恶化型劳力性心绞痛是指在相对稳定的劳力性心绞痛基础上心绞痛逐渐增强（疼痛更剧烈、时间更长或更频繁）。本例患者为老年女性，发作性胸骨闷痛，近1周劳动耐量减小、频率高及疼痛时间增加，符合其临床特点，故该患者最可能的诊断是恶化型劳力性心绞痛（B对）。心脏神经症（P224）（A错）多发生于中、青年，胸痛时间长短不一，可为短暂（几秒钟）的刺痛或持久（几小时）的隐痛，且胸痛部位可经常变动。心肌梗死（P236）（C错）患者疼痛持续时间长，程度较重，常烦躁不安、出汗、恐惧或有濒死感，且多伴有发热和心动过速等体征，严重者可引起休克，与本例不符。稳定型心绞痛（D错）是指由劳动诱发的短暂性胸痛发作，休息或舌下含服硝酸甘油后，胸痛迅速缓解的症状。本例发作频率高及疼痛时间增加，说明已由稳定型心绞痛发展为不稳定型心绞痛，故排除。肥厚型心肌病（P266）（E错）主要表现为劳力性呼吸困难和乏力，常伴有房颤，部分患者有晕厥，常于运动时出现。